2004年“陈化粮”事件曝光，部分粮库发现发霉的粮食，其原因最可能为
A. 掺杂过期粮豆
B. 储存、运输及销售过程中受到农药污染
C. 储存时自然变化
D. 原粮重金属残留
E. 储存不当害虫繁殖

正确答案：C。储存时自然变化

解析：本题考查粮食的自然陈化。自然陈化即粮豆类在储存过程中，由于自身酶的作用，营养素发生分解，从而导致其风味和品质发生改变的现象。“陈化粮”事件的原因最可能为粮食储存时的自然变化（C对ABDE错）。